代偿性代谢性酸中毒时NaHC03/H2C03的比值接近
A. 10/1
B. 20/1
C. 30/1
D. 43739
E. 40/1

正确答案：B。20/1

解析：代偿性代谢性酸中毒时PH在正常范围内，pH主要取决于HC03-与H2C03 比值，PH正常时NaHC03/H2C03的比值接近20/1（B对）。